用复合树脂充填深龋时
A. 用氧化锌丁香油水门汀作基底
B. 用磷酸锌水门汀作基底
C. 不必用基底
D. 用聚羧酸锌水门汀作基底

正确答案：D。用聚羧酸锌水门汀作基底

解析：本题考查窝洞垫底。聚羧酸锌水门汀强度高，且对牙髓刺激性小，用复合树脂充填深龋时可用聚羧酸锌水门汀作基底（D对）。氧化锌丁香油水门汀会影响树脂的聚合，用复合树脂充填时，不能用氧化锌丁香油水门汀作基底（A错）。磷酸锌水门汀能释放游离酸，刺激牙髓，不能用磷酸锌水门汀直接垫底（B错）。复合树脂未垫底直接充填可造成对牙髓的化学刺激而激惹牙髓，导致牙髓充血（C错）。